属DNA病毒的是
A. 甲型肝炎病毒
B. 乙型肝炎病毒
C. 丙型肝炎病毒
D. 丁型肝炎病毒
E. 戊型肝炎病毒

正确答案：B。乙型肝炎病毒

解析：1993年将甲型肝炎病毒（A错）归类于微小RNA病毒科中的嗜肝RNA病毒属，新型肠道病毒72型。乙型肝炎病毒（B对）属嗜肝DNA病毒科正嗜肝DNA病毒属。丙型肝炎病毒（C错），根据其结构和表型特征归为黄病毒科丙型肝炎病毒属。丁型肝炎病毒（D错）是一种缺陷的嗜肝单链RNA病毒。现认为HEV（E错）是a病毒亚组的成员。